在受溶出速度限制的吸收过程中，溶解了的药物立即被吸收的现象称为
A. 首过效应
B. 酶诱导作用
C. 酶抑制作用
D. 肝肠循环
E. 漏槽状态

正确答案：E。漏槽状态

解析：本题考查影响药物吸收的因素。漏槽状态（E对）是指药物的释放介质的浓度远小于其饱和浓度，溶解的药物立即被吸收，此时溶出是药物吸收的限速步骤；首过效应（A错）是指口服药物进入血液循环前药量损失的现象；酶的诱导作用（B错）指提高肝药酶活性，使药物代谢速率加快的作用；酶抑制作用（C错）是指酶的功能基团受到某种物质的影响，而导致酶活力降低或丧失的作用；肝肠循环（D错）指随胆汁排入肠道的药物，在肠道中重吸收，经门静脉又返回肝脏的现象。